下列对龈袋的描述错误的是
A. 牙龈肿胀增生
B. 龈沟可达3mm或更深
C. 上皮附着在釉牙骨质界水平
D. 出现结缔组织附着水平降低
E. 龈袋可能溢脓

正确答案：D。出现结缔组织附着水平降低

解析：本题考查牙龈的炎症的临床表现。对龈袋的描述错误的是出现结缔组织附着水平降低（D错，为本题的正确答案）。牙龈炎症时组织向冠方肿胀增生（A对），使龈沟加深，可达3mm或更深（B对）。此时结合上皮仍附着在正常的釉牙骨质界处（C对），未与牙面分离向根方增值，结缔组织附着水平不变。由于炎症存在，龈沟加深，会出现大量炎细胞的浸润和炎症介质的释放，形成脓液，龈袋内可能溢脓（E对）。